在釉质形成缺陷中最常见的类型的是
A. 釉质形成不全
B. 釉质成熟不全
C. 釉质钙化不全
D. 遗传性乳光牙本质
E. 畸形中央尖

正确答案：C。釉质钙化不全

解析：釉质钙化不全型为釉质形成缺陷中最常见的类型。掌握“釉质形成缺陷（釉质发育不全）”知识点。